心肌梗死的“损伤型”心电图改变主要表现在
A. R波电压降低
B. 异常Q波
C. T波直立高耸
D. ST段抬高
E. 出现U波

正确答案：D。ST段抬高

解析：心外膜下心肌损伤时（包括透壁性心肌缺血），ST段呈弓背向上抬高（D对）。RWP可以作为辅助诊断前间壁或前壁心肌梗死的一项重要指标（A错）。增宽加深超过正常范围的Q波称为异常Q波，常见于心肌梗死等（B错）。T波高耸常见于高钾血症，心内膜下心肌缺血及急性心肌梗塞超急性期表现（C错）。U波明显升高见于低钾血症，也可见于服用奎尼丁、洋地黄、肾上腺素等药物后。U波倒置见于高血压心脏病或冠心病等（E错）。